国家三级野生药材物种是指
A. 分布区域缩小的重要野生药材物种
B. 资源处于衰竭状态的重要野生药材物种
C. 资源严重减少的主要常用野生药材物种
D. 濒临灭绝状态的稀有珍贵野生药材物种
E. 濒临灭绝状态的重要野生药材物种

正确答案：C。资源严重减少的主要常用野生药材物种

解析：本题考查的是国家重点保护野生药材物种的分级。国家三级野生药材物种是指资源严重减少的主要常用野生药材物种（C对）。国家重点保护野生药材物种的分级：国家重点保护的野生药材物种分为三级管理。一级保护野生药材物种：系指濒临灭绝状态的稀有珍贵野生药材物种（D错）。二级保护野生药材物种：系指分布区域缩小，资源处于衰竭状态的重要野生药材物种（AB错）。三级保护野生药材物种：系指资源严重减少的主要常用野生药材物种。